某地痢疾发病近年来持续在较高水平，这种表现为
A. 统计地方性
B. 自然地方性
C. 自然疫源性
D. 非地方性表现

正确答案：A。统计地方性

解析：本题考查统计地方性的概念。统计地方性（A对BCD错）：由于生活条件、卫生条件和宗教信仰等社会因素使某一地区某些疾病发病率长期显著高于其他地区，与该地自然环境关联甚微。某地痢疾近年长期处于较高水平，是由于生活条件和卫生条件差所导致的，符合统计地方性的特点。